男，28岁。心悸、无力、手颤抖3个月，大便每日2～3次，不成形。体重下降5kg，1周前诊断为甲状腺功能亢进症，尚未治疗，昨晚饮白酒半斤，呕吐1次，晨起醒来发现双下肢不能活动。为避免再次出现下肢不能活动，甲亢治疗应采用
A. 抗甲状腺药物
B. 放射性碘
C. 肾上腺皮质激素
D. 立即行甲状腺手术
E. 复方碘溶液

正确答案：A。抗甲状腺药物

解析：青年男性患者，饮酒后呕吐，次日清晨双下肢不能活动，考虑甲亢性低钾性周期性瘫痪，与甲亢时肌细胞钠/钾-ATP酶活性升高、血清钾向细胞内急性转移有关。甲亢控制后，周期性瘫痪可在2～3个月内得到良好的恢复。为避免再次出现下肢不能活动，应在适当补充钾盐的同时采用抗甲状腺药物（A对）控制甲亢。放射性碘（B错）为美国治疗甲亢的首选方法，在我国不作首选。肾上腺皮质激素（C错）主要用于治疗甲状腺危象。立即行甲状腺手术（D错）治疗甲亢效果较好，但该患者目前尚无手术指征，不作首选。复方碘溶液（E错）主要用于甲亢的术前准备及治疗甲状腺危象。